下列哪项属于预防职业有害因素综合措施中的第一级预防
A. 穿戴个人防护用品
B. 在岗期间健康检査
C. 离岗时的健康检査
D. 转岗时的健康检査
E. 职业病的健康筛检

正确答案：A。穿戴个人防护用品